临产第2产程的标志是
A. 外阴膨隆
B. 胎头拨露
C. 胎头着冠
D. 宫口开全10cm
E. 肛门括约肌痉挛

正确答案：D。宫口开全10cm

解析：当宫口开全10cm（D对）时，标志第二产程开始。随产程进展，会阴体逐渐膨隆和变薄，肛门括约肌松弛，出现胎头拨露，继而出现胎头着冠。外阴膨隆（A错）、胎头拨露（B错）、胎头着冠（C错）及肛门括约肌痉挛（E错）均是在第二产程的过程中出现，但不是临产第二产程的标志。